Asherman综合征属于
A. 子宫性闭经
B. 卵巢性闭经
C. 垂体性闭经
D. 下丘脑性闭经
E. 精神性闭经

正确答案：A。子宫性闭经

解析：Asherman综合征多因人工流产刮宫过度或产后、流产后出血刮宫损伤子宫内膜，导致宫腔粘连而闭经，是子宫性闭经（A对）最常见的原因。卵巢性闭经（P354）（B错）闭经的原因在卵巢，由于卵巢分泌的性激素低下，子宫内膜不发生周期性变化而导致闭经。垂体性闭经（P354）（C错）主要病变在垂体，腺垂体器质性病变或功能失调，均可影响促性腺激素分泌，继而影响卵巢功能而闭经。下丘脑性闭经（P353）（D错）是最常见的，指中枢神经系统及下丘脑各种功能和器质性疾病引起的闭经，以功能性原因为主。精神性闭经（E错）是由突然或长期精神压抑、紧张、忧虑、环境改变等精神因素导致的闭经，属于下丘脑闭经的一种。